减轻鼻充血药伪麻黄碱的慎用人群
A. 高血压者
B. 高钾血症者
C. 乳酸血症者
D. 胰腺炎早期者
E. 甲状腺功能减退症

正确答案：A。高血压者

解析：本题考查药物的禁忌症。高血压患者（A对）应慎用伪麻黄碱。盐酸伪麻黄碱通过促进去甲肾上腺素的释放，间接发挥拟交感神经作用，使血压升高。